下列有关颞下颌关节检查不包括
A. 外形与关节动度检查
B. 咀嚼肌检查
C. 下颌运动检查
D. 胸锁乳突肌检查
E. （牙合）关系检查

正确答案：D。胸锁乳突肌检查

解析：本题考查颞下颌关节检查。下列有关颞下颌关节检查不包括胸锁乳突肌检查（D错，为本题的正确答案）。颞下颌关节检查包括：1.面型及关节动度检查（A对）；2.咀嚼肌检查（B对）；3.下颌运动检查（C对）；4.咬合关系检查（E对）。